治疗艾滋病的非核苷类逆转录酶抑制剂是
A. 利巴韦林
B. 依非韦伦
C. 阿昔洛韦
D. 拉米夫定
E. 替诺福韦

正确答案：B。依非韦伦

解析：本题考查依非韦伦。治疗艾滋病的非核苷类逆转录酶抑制剂是依非韦伦（B对）。非核苷类逆转录酶抑制剂：如奈韦拉平、依非韦伦等。利巴韦林（A错）用于治疗慢性丙型肝炎。阿昔洛韦（C错）用于单纯疱疹的治疗。拉米夫定（D错）为治疗乙型肝炎的二线药物。替诺福韦（E错）为治疗乙型肝炎的一线药物。